在心动周期中，占时间最长的是
A. 心房收缩期
B. 等容收缩期
C. 等容舒张期
D. 充盈期
E. 射血期

正确答案：D。充盈期